下列哪种血管病变可扪到静脉石
A. 葡萄酒斑状毛细血管瘤
B. 杨梅样毛细血管瘤
C. 血管痣
D. 海绵状血管瘤
E. 蔓状血管瘤

正确答案：D。海绵状血管瘤

解析：本题考查海绵状血管瘤（静脉畸形）。海绵状血管瘤（D对）（即静脉畸形），是由衬有内皮细胞的无数血窦所组成。窦腔内血液凝固而成血栓，并可钙化为静脉石，故可扪到静脉石。葡萄酒色斑状毛细血管瘤（A错）（即微静脉畸形），多发于颜面部皮肤，呈鲜红或紫红色，与皮肤表面平，边界清楚，以手指压迫病损，表面颜色褪去；解除压力后，血液立即充满病损区，恢复原有大小和色泽，不形成静脉石。杨梅样毛细血管瘤（B错）（即血管瘤），为真性肿瘤，表现为毛细血管扩张，周围绕以晕状白色区域；迅速变成红斑并高出皮肤；消退的过程缓慢，病损由鲜红变为暗紫、棕色，皮肤可呈花斑状，不存在静脉石。血管痣（C错）是婴儿最常见的良性肿瘤，是由胚胎期血管网增生所形成；血管痣分两种，血管瘤和血管畸形；血管瘤是由血管内皮细胞的增生所致，血管畸形则为血管的发育不良，可终生不消退，不能形成静脉石。蔓状血管瘤（E错）（即动静脉畸形），多见于成人，幼儿少见，病损高起呈念珠状，表面温度较正常皮肤高，患者可能自己感觉到搏动；扪诊有震颤感，听诊有吹风样杂音，病变可侵蚀基底的骨质，也可突入皮肤，使其变薄，甚至坏死、出血，没有静脉石。